胸廓畸形多见于
A. 3个月以内
B. 3～6个月
C. 6个月以上
D. 7～8个月以上
E. 12个月

正确答案：E。12个月

解析：胸廓畸形多见于1岁左右小儿，如佝偻病肋骨串珠，肋膈沟（郝氏沟），鸡胸，漏斗胸。掌握“维生素D缺乏性佝偻病”知识点。